下列有关医疗事故争议处理概述描述正确的是
A. 维护医疗秩序
B. 保障医疗安全
C. 促进医学科学的发展
D. 保护患者和医疗机构及其医务人员的合法权益
E. 以上说法均正确

正确答案：E。以上说法均正确

解析：为了正确处理医疗事故，保护患者和医疗机构及其医务人员的合法权益，维护医疗秩序，保障医疗安全，促进医学科学的发展。掌握“医疗事故行政处理、监督与法律责任”知识点。